党参的味
A. 极苦
B. 苦
C. 甜
D. 微甜
E. 涩

正确答案：D。微甜

解析：本题考查的是党参药材的性状鉴别。党参的味微甜（D对）。党参：【性状鉴别】药材呈长圆柱形，稍弯曲。表面灰黄色、黄棕色至灰棕色，根头部有多数疣状突起的茎痕及芽，每个茎痕的顶端呈凹下的圆点状，习称“狮子头”；根头下有致密的环状横纹，向下渐稀疏，有的达全长的一半，栽培品环状横纹少或无；全体有纵皱纹及散在的横长皮孔样突起，支根断落处常有黑褐色胶状物。质稍柔软或稍硬而略带韧性，断面稍平坦，有裂隙或放射状纹理，皮部淡棕黄色至黄棕色，木部淡黄色至黄色。有特殊香气，味微甜。味极苦（A错）的中药有黄连、苦参、山豆根、胡黄连、黄柏、关黄柏、马钱子、穿心莲等。味苦（B错）的中药有防己、北豆根、延胡索、远志、黄芩、川木香等。味甜（C错）的中药有川牛膝、黄精、山麦冬、枸杞子等。味涩（E错）的中药有桑寄生、鸡血藤、鱼腥草、五倍子等。